HIV主要侵犯
A. CD⁴⁺T淋巴细胞
B. CD⁸⁺T淋巴细胞
C. B淋巴细胞
D. NK细胞
E. CTL细胞

正确答案：A。CD⁴⁺T淋巴细胞

解析：HIV-1感染人体的靶细胞是CD⁴⁺淋巴细胞（A对），它通过感染免疫系统的中枢细胞CD⁴⁺淋巴细胞，激发异常的免疫反应，诱导有利于病毒繁殖的细胞因子微环境来扰乱整个免疫系统；CD ⁸⁺淋巴细胞（B错）具有对HIV特异的细胞溶解能力，在HIV感染初期具有抗病毒作用，故侵犯较少；HIV感染后主要损伤人体免疫系统，T细胞和B细胞（C错）均可被累及，以T细胞受损为主；NK细胞（D错）能杀伤和溶解HIV感染的以及未受感染的细胞，在病毒感染早期的免疫应答中起重要作用；CTL（E错）对几乎所有的HIV结构蛋白和一些调节蛋白的功能性位点产生反应，抑制病毒复制。